某人被诊断为肺水肿，其肺部出现下列哪种情况
A. 肺弹性阻力减小
B. 肺顺应性减小
C. 余气量减少
D. 功能残气量减少
E. 肺表面活性物质减少

正确答案：B。肺顺应性减小